职业性有害因素引起的职业性损害不包括
A. 职业病
B. 工伤
C. 职业特征
D. 急性职业中毒
E. 职业性多发病

正确答案：C。职业特征